嗜酸性腺瘤主要发生于
A. 腮腺
B. 下颌下腺
C. 腭腺
D. 舌下腺
E. 唇腺

正确答案：A。腮腺

解析：嗜酸性腺瘤无性别分布差异，主要发生于腮腺，其次为下颌下腺。也见于唇、腭、咽和颊黏膜等小唾液腺。掌握“沃辛瘤及嗜酸性腺瘤”知识点。